可引起胰岛素自身免疫综合征的抗甲状腺药是
A. 卡比马唑片
B. 复方碘口服液
C. 甲硫（巯）咪唑片
D. 甲状腺片
E. 丙硫氧嘧啶片

正确答案：C。甲硫（巯）咪唑片

解析：本题考查甲巯咪唑。可引起胰岛素自身免疫综合征的抗甲状腺药是甲硫（巯）咪唑片（C对）。甲巯咪唑可引起胰岛素自身免疫综合征，诱发产生胰岛素自身抗体，因分泌的胰岛素与胰岛素自身抗体结合不能发挥其生理作用，于是血糖升高进一步刺激胰岛细胞分泌胰岛素，胰岛素又继续与抗体相结合，使血清中有大量与胰岛素自身抗体结合的胰岛素，但与抗体结合的胰岛素极易解离，在进食后血糖高峰过后，胰岛素逐渐解离，而导致高游离胰岛素血症，诱发低血糖反应。卡比马唑片（A错）、复方碘口服液（B错）和丙硫氧嘧啶片（E错）为抗甲状腺药，均无引起胰岛素自身免疫综合征的不良反应。甲状腺片（D错）为甲状腺激素类药。